某女，39岁。情绪低落，闷闷不乐，喜叹息，胸闷胁痛，腹胀便溏，心烦不寐急躁易怒；舌红苔黄，脉弦细数。诊断为郁证，证属肝郁化火、肝脾不和。宜选用的中成药是
A. 舒肝平胃丸
B. 木香顺气丸
C. 人参健脾丸
D. 丹栀逍遥丸
E. 龙胆泻肝丸

正确答案：D。丹栀逍遥丸

解析：本题考查的是郁证的辨证论治。情绪低落，闷闷不乐，喜叹息，胸闷胁痛，腹胀便溏，心烦不寐急躁易怒；舌红苔黄，脉弦细数。诊断为郁证，证属肝郁化火、肝脾不和。宜选用的中成药是丹栀逍遥丸（D对）。郁证是由于情志不舒，气机郁滞所致，以心情抑郁，情绪不宁，胸部满闷，胁肋胀痛，或易怒喜哭，或咽中如有异物梗塞等症为主要临床表现的疾病。（一）肝气郁结证：【中成药应用】常用中成药有逍遥丸（水丸）、丹栀逍遥丸、越鞠丸。（二）痰气郁结证：【中成药应用】常用中成药有舒肝平胃丸（A错）。（三）心神失养证：【中成药应用】常用中成药有脑乐静、脑力静糖浆。（四）心脾两虚证：【中成药应用】常用中成药有归脾丸、人参归脾丸。木香顺气丸（B错）为积聚肝气郁结证的中成药应用。积聚肝气郁结证：【中成药应用】常用中成药有逍遥丸、木香顺气丸、宽胸舒气化滞丸。人参健脾丸（C错）为泄泻脾胃虚弱证的中成药应用。泄泻脾胃虚弱证：【中成药应用】常用中成药有人参健脾丸（大蜜丸）、补中益气丸（水丸）、参苓健脾胃颗粒。龙胆泻肝丸（E错）为耳鸣耳聋肝火上扰证的中成药应用。耳鸣耳聋肝火上扰证：【中成药应用】常用中成药有龙胆泻肝丸（水丸）、通窍耳聋丸、泻青丸。